对十二指肠溃疡采用选择性迷走神经切断术时，幽门成形术的作用是
A. 减少溃疡复发率
B. 利于消化与吸收
C. 防止发生腹泻
D. 避免发生胃潴留
E. 进一步降低胃酸

正确答案：D。避免发生胃潴留

解析：胃的运动和分泌主要受交感神经和迷走神经支配，迷走神经兴奋时胃的运动和分泌增强。迷走神经在胃窦处的鸦爪支控制胃窦的运动和幽门的排空，选择性迷走神经切断术切断了到胃的所有迷走神经支配，包括鸦爪支，导致使胃蠕动减弱，胃窦的功能丧失，引起胃滞留，因此选择性迷走神经切断术需附加幽门成形术，避免发生胃潴留（D对）。术后溃疡复发率（A错）与迷走神经切断是否彻底、迷走神经切断后的再生有关，食物的消化吸收（B错）与各种消化液的分泌量和小肠功能有关，而与附加幽门成形无关。腹泻是迷走神经切断术的并发症之一，可能与肠转运时间缩短、肠吸收减少等因素有关，因而幽门成形术不能防止腹泻的发生（C错）。胃酸的分泌主要受神经-体液因素的调节，附加幽门成形不会降低胃酸分泌（E错）。八版外科学已删除迷走神经切断术有关内容。